军团菌和支原体混合感染宜首选的抗菌药物是
A. 利奈唑胺
B. 头孢他啶
C. 头孢曲松
D. 罗红霉素
E. 头孢噻肟

正确答案：D。罗红霉素

解析：本题考查罗红霉素。罗红霉素（D对）是军团菌和支原体混合感染的首选。利奈唑胺（A错）临床主要用于敏感菌所致的感染。头孢他啶（B错）是铜绿假单胞菌感染首选的抗菌药。头孢曲松（C错）也属第三代头孢菌素，但对铜绿假单胞菌作用不及头孢他啶。头孢噻肟（E错）为第三代半合成头孢菌素，抗菌谱比头孢呋肟更广，对革兰阴性菌的作用更强，但对阳性球菌不如第一代与第二代头孢菌素。